男，43岁，刷牙出血2年，冷热刺激酸痛，无自发痛、夜间痛，下前牙咬合无力半年。检查：牙石指数为3，牙龈充血肿胀，下前牙松动Ⅱ度，牙龈退缩2mm，上下磨牙牙周探诊深度4～5mm，诊断应为
A. 牙龈炎
B. 慢性牙周炎
C. 快速进展型牙周炎
D. 牙髓炎
E. 弥漫型青少年牙周炎

正确答案：B。慢性牙周炎

解析：本题考查慢性牙周炎的临床表现。患者为中年男性，在刷牙时牙龈出血，病程较长，牙龈充血肿胀，有牙周袋和附着丧失，存在牙石，牙齿松动，慢性牙周炎多见于成年人，一般有较明显的菌斑牙石和牙龈炎症，患者的临床表现符合慢性牙周炎（B对）的病变特点。牙龈炎（A错）无附着丧失，这是区分牙龈炎和牙周炎的关键指征。快速进展型牙周炎（C错）是指在连续一段时间内病情进展迅速，破坏严重，发生于青春期到35岁之间的牙周炎，通常以年龄35岁以下和全口大多数牙的重度牙周破坏作为诊断标准。牙髓炎（D错）患者多伴有冷热刺激痛。弥漫型青少年牙周炎（E错）发生于青春期，可以侵犯全口牙齿。一般乳牙不受侵犯，病变发展很快，患者20岁左右即需拨牙或牙齿自行脱落，在早期就可出现牙齿松动和移动，早期患者的菌斑、牙石很少，牙龈炎症轻微，但有深牙周袋形成，袋底部位可有龈下菌斑，袋壁有炎症，探诊易出血，晚期可发生牙周脓肿。